病原微生物属于
A. 生物性致病因素
B. 先天性致病因索
C. 理化性致病因素
D. 免疫性致病因素
E. 遗传性致病因素

正确答案：A。生物性致病因素

解析：生物性致病因素（A对）主要包括病原微生物和寄生虫；先天性致病因素（B错）主要包括损害婴儿发育的因素，如多指，先天性心脏病等；理化性致病因素（C错）主要包括高温（或寒冷）、高压（或突然减压）、电流、辐射、机械力、噪声、强酸、强碱及毒物等；免疫性致病因素（D错）主要包括免疫反应过强、免疫缺陷或自身免疫反应等；遗传性致病因素（E错）主要包括染色体畸变和基因变异等引起的疾病。